下列能使心输出量增加的因素是
A. 心迷走中枢紧张性增高
B. 心交感中枢紧张性增高
C. 静脉回心血量减少
D. 心室舒张末期容积减小
E. 颈动脉窦内压力增高

正确答案：B。心交感中枢紧张性增高

解析：心脏受心交感神经和心迷走神经双重支配：心交感中枢紧张性增高（B对）即心交感神经兴奋时，心肌表现为正性肌力效应即心率增快、传导增快、收缩力加强及心输出量增加；心迷走中枢紧张性增高（A错）即心迷走神经兴奋，末梢释放的乙酰胆碱作用于心肌细胞的M受体，引起负性效应，即心率减慢、传导减慢、收缩力较弱和心输出量减少。静脉回心血量减少（C错），使舒张末期心室充盈量减少，心室舒张末期容积减小（D错），前负荷降低（P93），心输出量减少。颈动脉窦压力增高（E错），减压反射增强（P135），使心输出量减少。